慢性肾炎患者，全身性浮肿。尿常规检查：尿蛋白（+++），此患者引起浮肿的主要原因是
A. 毛细血管血压升高
B. 组织液胶体渗透压升高
C. 血浆胶体渗透压降低
D. 毛细血管壁通透性增加
E. 淋巴回流受阻

正确答案：C。血浆胶体渗透压降低

解析：本例患者有全身水肿病史，由尿蛋白（+++）可判断出该患者血浆胶体含量下降，故此患者引起浮肿的主要原因是血浆胶体渗透压降低（C对）。由毛细血管血压升高（A错）引起的水肿多见于右心衰竭患者。由组织液胶体渗透压升高（B错）引起的水肿多见于甲状腺功能减退患者。由毛细血管壁通透性增加（D错）引起的水肿多见于变态反应性疾病。由淋巴回流受阻（E错）引起的水肿多见于丝虫病等。